预防龋齿最主要的卫生措施是
A. 保持口腔卫生
B. 少吃糖
C. 少吃酸性食物
D. 加强营养
E. 药物预防

正确答案：A。保持口腔卫生

解析：本题考查预防龋齿最主要的卫生措施。预防龋齿最主要的卫生措施就是保持口腔卫生（A对BCDE错），最好在每次进食以后进行漱口。确保儿童每日早晚刷牙，并保证刷牙的效果，选用适合儿童年龄的牙刷和牙膏。